患者，女，43岁。入院时诊断为肠痈。现腹皮挛急，全腹压痛、反跳痛，腹胀，恶心、呕吐，大便不爽，次数增多，小便频数，时时汗出，皮肤甲错，二目下陷，口干而臭，舌红苔黄糙，脉细数。其证候是
A. 积热不散，热盛肉腐
B. 阳明腑实，热盛伤阴
C. 寒湿内蕴，瘀血凝滞
D. 湿热内蕴，气血瘀滞
E. 邪毒内蕴，瘀血凝滞

正确答案：B。阳明腑实，热盛伤阴

解析：肠痈酿脓期，其证候为阳明腑实，热盛伤阴，热邪较初期更甚，邪热壅滞于肠腑，渐成阳明腑实，加之热盛肉腐而成之败血，气血凝滞不通，出现腹皮挛急，全腹压痛、反跳痛，腹胀；湿热未尽，脾胃运化升降失常，腑气不畅，出现恶心、呕吐，大便不爽，次数增多，口干而臭，舌红苔黄糙；邪热逼迫津液偏渗，出现小便频数，时时汗出；邪热伤阴，肌肤失于濡润，出现皮肤甲错，二目下陷，脉细数（B对）。积热不散，热盛肉腐为肠痈酿脓期的证候（A错）。寒湿内蕴，瘀血凝滞为肠痈初期两种证候之一，表现为开始腹痛较轻，身无寒热或微热，大便微溏，小便清长，苔薄白腻或微灰，脉迟紧或濡数（C错）。湿热内蕴，气血瘀滞为肠痈初期另一证候，表现为转移性有下腹疼痛，呈持续性、进行性加剧，右下腹局限性压痛或据按，伴轻度发热，恶心纳呆，小便微黄，大便干结，舌苔厚腻，脉弦滑（D错）。邪毒内蕴，瘀血凝滞不是本病例的证候（E错）。